串联试验可以提高诊断方法的
A. 特异度
B. 灵敏度
C. 约登指数
D. 一致性
E. 诊断准确性

正确答案：A。特异度

解析：本题考查串联试验的特点。串联试验，也称系列试验，即一组筛检试验按一定的顺序相连，初筛阳性者进入下一轮筛检，全部筛检试验结果均为阳性者才定为阳性。该法可以提高特异度（A对BCDE错），但会使灵敏度降低。